在口腔修复前可考虑拔除的残根是
A. 残根缺损达龈下，可用牙少量移动矫正技术牵引到适当位置
B. 残根出现根侧壁穿孔，可用牙少量移动矫正技术牵引到适当位置
C. 残根破坏较大，缺损达龈下，治疗效果不佳者
D. 残根较稳固，根周病变范围较小
E. 残根较稳固，根周组织无明显病变

正确答案：C。残根破坏较大，缺损达龈下，治疗效果不佳者

解析：本题考查余留牙的保留与拔除。在口腔修复前可考虑拔除的残根是残根破坏较大，缺损达龈下，治疗效果不佳者（C错，为本题的正确答案）。确定残根的拔除或保留根据牙根缺损的破坏范围、根尖周组织的健康状况，并结合治疗效果和修复的关系综合考虑。①如果残根破坏较大，缺损达龈下，无法经牙冠延长术或正畸术牵引获得生物学宽度，根尖周组织破坏广泛，治疗效果不佳者，可考虑拔除；②如果残根较稳固，根尖周组织无明显病变或病变范围小，同时对义齿的支持和固定有作用者，则应进行根管治疗后保留（DE对）。